克罗恩病典型的表现中不包括
A. 受累肠段弥漫性充血水肿伴糜烂
B. 病变呈节段性分布
C. 纵行溃疡
D. 裂隙样溃疡
E. 铺路石样改变

正确答案：A。受累肠段弥漫性充血水肿伴糜烂

解析：克罗恩病典型的表现有：病变呈节段性或跳跃性（B对）；形成纵行溃疡（C对）和裂隙样溃疡（D对）；黏膜呈铺路石样改变（E对）。受累肠段弥漫性充血水肿伴糜烂（A错，为本题正确答案）是溃疡性结肠炎的表现。